下列关于维生素B₂的叙述正确的是
A. 遇酸可发生脱水反应生成脱水产物
B. 光照氧化后可生成硫色素
C. 在体内经磷酸化后生成黄素单核苷酸
D. 有吡多醇（吡多辛）、吡多醛和吡多胺三种形式
E. 氧化生成多聚糠醛，是该物质变色的主要原因

正确答案：C。在体内经磷酸化后生成黄素单核苷酸

解析：本题考查维生素。维生素B₂在体内经磷酸化后生成黄素单核苷酸（C对），为氧化还原酶的辅酶，广泛参与细胞氧化还原系统传递氢的反应。维生素A为脂溶性维生素，遇酸可发生脱水反应生成脱水产物（A错）。维生素B₁光照氧化后可生成硫色素（B错），参与维持正常的糖代谢及神经、心脏系统功能。维生素B₆有吡多醇（吡多辛）、吡哆醛和吡哆胺三种形式（D错）。维生素C为水溶性维生素，极易被氧化，氧化生成多聚糠醛（E错）。